模仿能力的最快发展阶段为
A. 6～8岁
B. 9～12岁
C. 10～12岁
D. 14～16岁
E. 16～18岁

正确答案：B。9～12岁